局限性胸痛，按压后疼痛加重，提示病变主要累及的部位是
A. 临近胸膜肺组织
B. 胸壁软组织
C. 脏层胸膜
D. 肋间神经
E. 壁层胸膜

正确答案：B。胸壁软组织

解析：局限性胸痛且按压后疼痛加剧，可以考虑病变累及胸壁软组织（B对）。临近胸膜肺组织（A错）、脏层胸膜（C错）和壁层胸膜（E错）发生病变时，疼痛多为弥漫性。肋间神经痛（D错）为带状分布。